男，34岁，左上第三磨牙阻生颊侧移位，要求拔除。行上齿槽后神经阻滞麻醉后左面颊部立即肿胀。可能的诊断是翼静脉丛损伤，发生上述情况时，哪项处理不正确
A. 立即冰敷
B. 立即热敷
C. 加压包扎
D. 应用止血药
E. 应用抗生素

正确答案：B。立即热敷

解析：本题考查局麻的并发症-血肿。血肿形成后，应立即压迫止血（C对），并冰敷（A对），可视情况给予止血药（D对）及抗生素（E对）；应在48h后热敷，否则会引起血肿的加重（B错，为本题的正确答案）。